MDS-RCMD不可能出现的异常表现是
A. 骨髓造血祖细胞培养集落形成减少
B. 难治性贫血
C. 外周血可见幼稚细胞
D. 血小板减少
E. 骨髓原始细胞>5%

正确答案：E。骨髓原始细胞>5%

解析：难治性血细胞减少伴多系病态造血（RCMD）（B对）外周血血细胞减少，原始细胞无或少见（＜1％）²（C对）；骨髓≥两系病态造血的细胞≥10％（D对），原始细胞＜5％（E错，为本题正确答案）。MDS患者的体外集落培养常出现集落“流产”，形成的集落少或不能形成集落（A对）。